男，45岁。慢性腹泻6年。每日大便3～4次，便中有少量黏液脓血，抗生素治疗无效。查体：T36.5℃，P80次/分，R18次/分，BP120/80mmHg。双肺呼吸音清，未闻及干湿性啰音，心律齐，腹软，无压痛。结肠镜检查：直肠、乙状结肠多发糜烂及浅溃疡。首选的药物是
A. 口服硫唑嘌呤
B. 口服柳氮磺吡啶
C. 静脉应用环孢素
D. 口服泼尼松
E. 静脉应用甲泼尼龙

正确答案：B。口服柳氮磺吡啶

解析：患者中年男性，慢性腹泻6年（慢性病史，排除急性细菌感染）。每日大便3～4次，便中有少量黏液脓血，抗生素治疗无效。查体无异常。结肠镜检查见直肠、乙状结肠多发糜烂及浅溃疡。根据患者病史、临床表现、体格检查、结肠镜检查，可以诊断为溃疡性结肠炎。患者每日大便3～4次，每日大便3～4次，为轻度溃疡性结肠炎（轻度：腹泻＜4次/日，便血轻或无，无发热，贫血无或轻，血沉正常），柳氮磺吡啶是治疗轻、中度或经糖皮质激素治疗已有缓解的重度UC常用药物，首选口服柳氨磺吡啶（B对）。硫唑嘌呤和环孢素都属于免疫抑制剂，免疫抑制剂可试用于对激素治疗效果不佳或对激素依赖的慢性持续型病例，而患者为轻度（AC错）（P376）。泼尼松和甲泼尼龙都属于糖皮质激素，糖皮质激素 对急性发作期有较好疗效，可用于对5-ASA（5-氨基水杨酸）疗效不佳的轻、中度患者，特别适用于重度的患者，而患者为轻度（DE错）。